急诊处方依法应保存的年限是
A. 2年
B. 3年
C. 1年
D. 4年
E. 5年

正确答案：C。1年

解析：医疗机构应当妥善保存处方：①普通处方，急诊处方，儿科处方保存期限为1年（C对）。